维生素D缺乏性佝偻病初期的临床表现是
A. 神经、精神症状
B. 全身肌肉松弛
C. 腕踝畸形
D. 出牙延迟
E. 颅骨软化

正确答案：A。神经、精神症状

解析：维生素D缺乏性佝偻病初期的临床表现多见于6个月以内的小婴儿，多为神经兴奋性增高的表现，如易激惹、烦闹、汗多刺激头皮而摇头，但这些并非佝偻病的特异症状，仅作为临床早期诊断的参考依据。